龈下牙石易沉积的牙面是
A. 近中面
B. 远中面
C. 唇颊面
D. 舌腭面
E. 舌腭面、邻面

正确答案：E。舌腭面、邻面

解析：本题考查龈下牙石。龈下牙石指位于龈缘以下的牙石，多位于牙齿不易清洁的部位，如牙齿的舌腭面和邻面（E对D错）。近中面（A错）、远中面（B错）即邻面间隙隐秘不易清洁龈下易沉积牙石，舌腭面位于牙齿的内侧不易清洁，且下前牙舌侧有唾液腺存在，分泌大量的唾液，唾液中的钙盐沉积形成龈下、龈上舌侧牙石。唇颊面（C错）位于外侧易于清洁，不易形成龈下牙石。